关于氧化呼吸链的说法，下列错误的是
A. 酶与辅酶在线粒体内膜上按照一定顺序排列组成的递氢或递电子体称为呼吸链
B. NADH氧化呼吸链参与线粒体内氧化磷酸化反应
C. FADH2氧化呼吸链参与线粒体内氧化磷酸化反应
D. 两条呼吸链的反应过程最后都将电子传递给氧，生成水
E. 两条呼吸链的交叉点为Cytb

正确答案：E。两条呼吸链的交叉点为Cytb

解析：酶与辅酶在线粒体内膜上按照一定的顺序排列组成的递氢或递电子体系称为呼吸链。线粒体内参与氧化磷酸化的呼吸链主要有两条，即NADH氧化呼吸链和FADH2氧化呼吸链。二者电子传递链的交叉点是辅酶Q（CoQ）。掌握“氧化磷酸化”知识点。